不属于上眼睑的结构的是
A. 眼轮匝肌
B. 上睑板
C. 上睑提肌
D. 睑板腺
E. 泪囊

正确答案：E。泪囊

解析：上眼睑包括眼轮匝肌（A对）、上睑板（B对）、上睑提肌（C对）和睑板腺（位于上睑板内）（D对），但泪囊（E错，为本题正确答案）不属于上眼睑的结构。